佝偻病激期X线所见为
A. 骨质密度正常
B. 骨骺软骨变窄
C. 临时骨钙化带模糊、消失
D. 骨骺与于骺端的距离多无变化
E. 骨膜增生

正确答案：C。临时骨钙化带模糊、消失

解析：佝偻病活动期（激期）X线检查干骺端临时钙化带模糊或消失，呈毛刷样，并有杯口状改变；骺软骨明显增宽，骨骺与干骺端距离加大；骨质普遍稀疏，密度减低，可有骨干弯曲或骨折。掌握“维生素D缺乏性佝偻病”知识点。